可摘局部义齿人工后牙颊舌径宽度小于天然牙的目的是
A. 提高咀嚼效率
B. 获得平衡
C. 防止咬颊
D. 减小支持组织负荷
E. 增强固位

正确答案：D。减小支持组织负荷

解析：本题考查可摘局部义齿人工后牙颊舌径宽度小于天然牙的目的。人工牙的（牙合）面大小与支持组织所受力的大小有关系，（牙合）面越大，则其支持组织所受（牙合）力越大，为了减轻支持组织的负荷，适当减少颊舌径（D对），近远中径是不动的，会影响邻接。为提高咀嚼效率（A错），应使用解剖式牙尖。为获得平衡（B错），应消除义齿不稳定的因素，防止翘起、摆动、旋转、下沉，如增加平衡力矩，减少转动力矩，增加游离端支持，消除支点，建立良好的咬合关系。为防止咬颊（C错），应有正常的覆盖关系。为增强固位（E错），应综合考虑基牙的数目、固位形、位置，义齿的就位道，卡环的材料选择、制作等因素。